引起咽结合膜热的病原体是
A. 流感病毒
B. 腺病毒
C. 鼻病毒
D. 链球菌
E. 柯萨奇病毒

正确答案：B。腺病毒

解析：引起咽结合膜热的病原体是腺病毒，是特殊型上感。好发于春夏季，多呈高热，咽痛，眼部刺痛（B对）。流感病毒可引起人、禽、猪、马、蝙蝠等多种动物感染和发病，是人流感、禽流感、猪流感、马流感等人与动物疫病的病原（A错）。人鼻病毒是小RNA病毒科、鼻病毒属的一种，是人患普通感冒的主要病原（C错）、链球菌引起的疾病主要有：化脓性炎症、毒素性疾病和超敏反应性疾病等（D错）。 柯萨奇病毒是一类常见的经呼吸道和消化道感染人体的病毒，感染后人会出现发热、打喷嚏、咳嗽等感冒症状（E错）。